前列腺增生手术的禁忌症
A. 出现过梗阻的病人
B. 并发肾积水
C. 有严重肝肾功能不全
D. 尿流率检查异常
E. 膀胱刺激征

正确答案：C。有严重肝肾功能不全

解析：手术疗法适应症：残余尿在60ml以上；发生过输尿管积水（B错）；因梗阻导致泌尿系感染（A错）；急性尿潴留导尿失败；膀胱逼尿肌功能未受损（DE错）。禁忌症：严重肝肾功能不全（C对）。